霍恩法的要求是
A. 4个染毒剂量组
B. 每组动物4只或5只
C. 组距3.16倍
D. 组距2.15倍
E. 以上都是

正确答案：E。以上都是